患者，女，45岁，血压160/95mmHg（21.3/12.6kPa）以上，已持续2年。现眩晕头痛，腰膝酸软，耳鸣多梦，心烦易怒，苦咽干，手足心热，舌红少苔，脉弦细数。其证型是
A. 肝火亢盛
B. 肝风上扰
C. 阴虚阳亢
D. 痰浊中阻
E. 阴阳两虚

正确答案：C。阴虚阳亢

解析：患者近2年血压持续160/95mmHg以上，可诊断为高血压病，属中医“眩晕”范畴，根据患者眩晕头痛，腰膝瘦软，耳鸣多梦，心烦易怒，苦咽干，手足心热，舌红少苔，脉弦细数的舌脉证，可判断患者为肝肾阴虚，此为阴虚阳亢之证（C对）。肝火亢盛证可见头晕头痛，口苦咽干，面红目赤，烦躁易怒，舌红，苔薄黄，脉弦细有力等肝火上扰的实证表现（A错）。肝风上扰证可见抽搐等肝阳化风的表现（B错）。痰浊中阻证可见头晕头痛，投中如裹，困倦乏力，胸闷，脘脾，呕吐痰涎等痰湿内盛的表现（D错）。阴阳两虚证可见腰膝酸软，形寒肢冷，头晕眼花，脉沉细欲绝等阴阳两虚的表现（E错）。